在气雾剂中，丙二醇可作为
A. 助悬剂
B. 絮凝剂
C. 潜溶剂
D. 润湿剂
E. 抛射剂

正确答案：C。潜溶剂

解析：本题考查气雾剂的附加剂。潜溶剂（C对）为提高难溶性药物的溶解度常使用的混合溶剂，常与水形成潜溶剂的有乙醇、丙二醇、甘油、聚乙二醇等。